下列哪项不是丹毒的临床特点
A. 病起缓慢，恶寒发热
B. 局部皮肤焮热肿胀，迅速扩大
C. 局部皮肤忽然变赤
D. 好发于小腿部
E. 容易复发

正确答案：A。病起缓慢，恶寒发热

解析：丹毒系由火毒侵犯，郁于肌肤而发的一种急性感染性疾病。丹毒起病急（A错，为本题正确答案），病起皮肤突然发红（C对），色如丹涂，焮热肿胀，迅速扩大（B对），好发于足背、小腿（D对）、面部等处，数日内可逐渐痊愈，但常易复发（E对）。